乳牙形态不同于恒牙的描述中，错误的是
A. 乳牙色泽呈乳黄色
B. 乳牙冠根分明
C. 乳牙相对自身牙体髓腔较大
D. 乳前牙的牙冠相对较宽
E. 乳牙牙冠呈乳白色偏青白

正确答案：A。乳牙色泽呈乳黄色

解析：本题考查乳牙的形态特点以及与恒牙的鉴别。乳牙色泽呈乳黄色（A错，为本题正确答案）不符合乳牙与恒牙的鉴别特点。乳牙呈乳白色（E对），体积较同名恒牙小，牙冠短而宽。乳牙颈部缩窄，颈嵴突出，牙根明显缩小，冠根分明（B对），牙髓腔较大（C对），宽冠窄根是乳前牙的特点（D对），但上颌乳中切牙为宽冠宽根。上颌乳尖牙的近中牙尖嵴长于远中牙尖嵴，是乳尖牙和恒尖牙中牙尖唯一偏远中者。乳磨牙体积依次递增，下颌第二乳磨牙近中颊尖、远中颊尖和远中尖等大。乳磨牙牙合方聚合度大，牙合面缩窄，尖、嵴、窝、沟不清晰。除上颌乳中切牙牙根扁宽外，其余乳前牙牙根细长，根尖均偏唇侧。乳磨牙根干特短，分叉度特大，上颌乳磨牙为三根，即近、远中颊根和舌根，下颌乳磨牙为二根，即近中根和远中根。